白花蛇的功效是
A. 祛风，解表，止痛
B. 祛风，通络，利尿
C. 祛风，通络，止痉
D. 祛风湿，强筋骨
E. 祛风湿，治骨鲠

正确答案：C。祛风，通络，止痉

解析：该题考查白花蛇的功效，属记忆内容。白花蛇味甘、咸，性温；有毒，入肝经；具有祛风，通络，止痉的功效（C对ABCD错）。